普通型和典型偏头痛两者的区别之一，在于后者一定有
A. 搏动性头痛
B. 恶心、呕吐
C. 畏光、畏声
D. 神经系统检查无异常
E. 10～40分钟先兆症状

正确答案：E。10～40分钟先兆症状

解析：普通型偏头痛现称无先兆偏头痛，其发病特点为没有先兆，表现出反复发作的额颞部搏动性头痛，伴有恶心呕吐、畏光畏声等症状。典型偏头痛现称先兆偏头痛，发病特点为头痛表现前一定会有10-40分钟（7版神经病学已改为5-20分钟）先兆症状。因此普通型和典型偏头痛两者的区别之一，在于后者一定有先兆症状（E对），其余搏动性头痛（A错）、恶心呕吐（B错）、畏光畏声（C错）、神经系统检查无异常（D错）等为二者共有表现。